“其脉自浮，外证骨节疼痛，恶风”属于水气病中的
A. 皮水
B. 石水
C. 正水
D. 风水
E. 黄汗

正确答案：D。风水

解析：风水起于外邪袭表犯肺，肺气不宣，通调失职，以至于水湿泛溢于肌表，故病初有明显的表证，如脉浮、恶风、骨节疼痛等。此处未言发热、身肿等情况，但临证时可见，当予以注意（D对）。皮水与肺脾两脏相关，肺主表卫而脾主四肢，若肺失通调，脾失健运。则水停肌肤而肿势加重，症见肢体肿甚，按之没指。不恶风提示无表证。可与风水相鉴别。腹如鼓而不满，可见里湿壅聚未盛。当发其汗，为风水和皮水提出了具体治法。风水因风邪在表，发汗散邪可恢复肺之宣肃通调。皮水因水停肌肤，发汗可使水从肌表而出，亦属因势利导之举（A错）。正水脉沉迟，提示肾阳不足，阳虚而水聚于内，上射于肺，可见腹满而喘（C错）。石水脉沉亦为阳虚而水停于里，又水寒凝结于下，见少腹硬满如石，故名（B错）。水聚于下，未影响到上，故不喘。阳虚阴凝，水液不循常道，故正水、石水均可见身肿之症。喘之有无，又是两者鉴别要点之一。黄汗病以汗出色黄如柏汁为主症。因其初起有发热、四肢头面肿等，故有必要与风水相鉴别。黄汗病起于外受水湿，水湿留滞于肌肤，营卫郁滞，故见脉沉迟、发热而四肢头面肿。湿从热化，郁蒸营分，日久不愈，又可发为痈脓（E错）。